关于腭裂引起的畸形和功能障碍，错误的是
A. 可单独发生，也可与唇裂伴发
B. 主要是软组织畸形，其次是骨组织畸形
C. 对病人吸吮、进食及语言等功能的影响严重
D. 常因颌骨发育不良导致面中份凹陷和咬合错乱
E. 不仅影响病人生活、学习、工作，还易造成心理障碍。

正确答案：B。主要是软组织畸形，其次是骨组织畸形

解析：本题考查腭裂引起的畸形和功能障碍。腭裂多发生于腭骨，骨组织畸形为主要畸形，而软组织畸形为继发畸形（B错，为本题的正确答案）。腭裂和唇裂是口腔颌面部常见的先天性畸形，它可单独发生也可与唇裂同时伴发（A对）。由于患儿腭部裂开，使口、鼻相通，口腔内不能或难以产生负压，因此患儿无力吮吸、进食、发音（C对）。腭裂本身伴有先天性上颌骨发育不足，手术损伤对上颌骨发育影响越大，随着患儿年龄增长越来越明显，导致面中部凹陷畸形及反（牙合）、开（牙合）等咬合畸形（D对）。由于容貌障碍、发音缺陷不仅对患儿生活、学习、生活，还易造成心理障碍（E对）。